患者，男，65岁，因头痛、头晕就诊，查体血压170/95mmHg，心律齐。诊断为高血压，应选用的药物是
A. 胺碘酮
B. 氟桂利嗪
C. 硝酸异山梨酯
D. 呋塞米
E. 氨氯地平

正确答案：E。氨氯地平

解析：本题考查氨氯地平。氨氯地平（E对）为二氢吡啶类抗高血压药物，适用于老年高血压、单纯收缩期高血压，伴稳定型心绞痛、冠状动脉或颈动脉粥样硬化及周围血管病患者。胺碘酮（A错）为转复房颤的药物，静脉注射时，其转复房颤的成功率是34%～69%，常用剂量是3～7mg/kg，口服胺碘酮转复成功率为15%～40%。胺碘酮的不良反应有低血压、视力模糊、心动过缓、甲状腺功能异常、肝功能损害，静脉炎等。氟桂利嗪（B错）用于脑供血不足，椎动脉缺血，脑血栓形成；耳鸣，脑晕；偏头痛预防；癫痫辅助治疗。硝酸异山梨酯（C错）用于冠心病的长期治疗，心绞痛的预防，心肌梗死后持续心绞痛的治疗；与洋地黄和（或）利尿剂联合应用，治疗慢性充血性心力衰竭，肺动脉高压的治疗。利尿剂可减轻心脏负荷，适量应用至关重要，剂量不足则体液潴留，剂量过大则容量不足，袢利尿剂，如呋塞米（D错）对轻度心衰患者从小剂量开始进行给药，逐渐加量，静脉注射效果优于口服，其主要不良反应是低血钾。